创伤性休克的治疗，除了补足血容量，还应该使用以下哪种药物
A. 血管收缩剂
B. 止痛剂
C. 镇静剂
D. 血管扩张剂
E. 肌松剂

正确答案：D。血管扩张剂

解析：创伤性休克的治疗中还应在补足血容量的情况下，使用血管扩张剂。掌握“休克”知识点。